混杂因素成立的基本条件
A. 只需与所研究疾病有关联
B. 与所研究疾病有关联，又与研究因素（暴露因素）有关
C. 不是研究因素与研究疾病因果链上的中间变量
D. 是研究因素与研究疾病因果链上的中间变量
E. 既与所研究疾病有关联，又与研究因素（暴露因素）有关，并且不是研究因素与研究疾病因果链上的中间变量

正确答案：E。既与所研究疾病有关联，又与研究因素（暴露因素）有关，并且不是研究因素与研究疾病因果链上的中间变量